动物免疫血清的除菌宜采用
A. 高压蒸汽灭菌
B. 干烤
C. 滤过除菌
D. 紫外线
E. 煮沸消毒

正确答案：C。滤过除菌